患者，女性，18岁，右上侧切牙冠折2/3，咬合关系正常，患牙经根管治疗后，最好选用哪种桩冠修复
A. 成品桩桩冠
B. 铸造舌背桩冠
C. 铸造桩核烤瓷冠
D. 0．8mm不锈钢丝弯制桩冠
E. 1．0mm不锈钢丝弯制桩冠

正确答案：C。铸造桩核烤瓷冠

解析：本题考查桩冠及烤瓷冠修复。患牙剩余可利用牙体组织不足，无法形成足够的全冠固位形，需桩核来为最终全冠修复体提供支持和固位。桩冠为利用桩插入根管内以获得固位体（B错）。现多用桩核冠替代桩冠进行更合理方便的修复设计，铸造金属桩核为一体，固位力较成品桩桩冠（A错）更大，有良好的机械性能，高强度不易折断，同时烤瓷冠也具有美观耐磨，机械性能好的特点，因此最佳设计为铸造桩核烤瓷冠（C对）。桩核有纤维桩，金属桩，陶瓷桩。金属桩有预成桩和铸造桩两种，临床已不用0．8mm不锈钢丝弯制桩冠（D错）和1．0mm不锈钢丝弯制桩冠（E错）。